上颌前牙颈部的唇舌向倾斜方向为
A. 中切牙向唇侧，侧切牙、尖牙向腭侧
B. 中切牙、侧切牙向唇侧，尖牙向腭侧
C. 中切牙、侧切牙向腭侧，尖牙向唇侧
D. 中切牙向腭侧，侧切牙、尖牙向唇侧
E. 中切牙、侧切牙和尖牙均向腭侧

正确答案：C。中切牙、侧切牙向腭侧，尖牙向唇侧

解析：本题考查上颌前牙颈部的唇舌向倾斜方向。上颌中切牙颈部略向腭侧倾斜，上颌侧切牙颈部向腭侧倾斜程度大于上颌中切牙，上颌尖牙颈部微突向唇侧（C对），全口义齿修复排牙时前牙颈部的唇舌向的倾斜规律与自然牙列一致，有利于前牙的美观自然；另外上颌中切牙和侧切牙牙颈部向腭侧倾斜，便于与下颌前牙形成浅覆（牙合）浅覆盖。